下列对沙苑子的描述正确的是
A. 外表面灰棕色或黄棕色
B. 有香气
C. 两者均是
D. 两者均不是

正确答案：D。两者均不是

解析：本题考查的是沙苑子药材的性状鉴别。沙苑子表面绿褐色至灰褐色、气微（D对）。沙苑子：【性状鉴别】药材略呈圆肾形而稍扁。表面绿褐色至灰褐色（A错），光滑，边缘一侧微凹处具圆形种脐。质坚硬，不易破碎。除去种皮，有淡黄色子叶2片，胚根弯曲。气微（B错），味淡，嚼之有豆腥味。